下列哪种不是疫苗
A. 亚单位疫苗
B. 基因工程疫苗
C. 合成肽疫苗
D. 人免疫球蛋白制剂
E. DNA疫苗

正确答案：D。人免疫球蛋白制剂